药物代谢的主要器官是
A. 肝脏
B. 肾脏
C. 肺
D. 胆
E. 心脏

正确答案：A。肝脏

解析：本题考查药物代谢的部位。药物代谢的主要部位是肝脏（A对），它含有大部分代谢活性酶；除肝脏以外，胃肠道亦是常见的代谢部位，小肠黏膜上含有很多代谢酶，肠内的菌丛亦能代谢药物；在血浆、肺、肾脏、鼻黏膜、脑、脾以及皮肤等其它组织也存在较弱的代谢反应，但这些组织均不是药物主要的代谢部位。